过敏性紫癜最常见的类型是
A. 混合型
B. 肾型
C. 关节型
D. 腹型
E. 单纯型

正确答案：E。单纯型

解析：过敏性紫癜多见于青少年，男性略多于女性，春秋季节发病较多。其中单纯型（紫癜型）为最常见类型。掌握“过敏性紫癜”知识点。